男性，70岁。体重50kg，因胃癌进行手术治疗。为补充术中失血，给予输注全血。当全血输注至1000ml时，患者突然出现呼吸困难，咳嗽，肺部湿性啰音，脉搏130次/分，血压160/90mmHg．患者很可能发生了
A. 溶血性输血反应
B. 输血相关过敏反应
C. 输血相关循环超负荷
D. 输血相关败血症
E. 输血相关急性肺损伤

正确答案：C。输血相关循环超负荷

解析：患者为老年男性，在大量输血后突然出现心率加快（心脏负荷增大）、高血压等循环系统高负荷表现及呼吸困难、咳嗽、肺部湿性啰音等急性肺水肿的表现，表明患者很可能发生了输血相关循环超负荷（C对）。循环超负荷（P23）常由于输血速度过快或过量而引起，好发于老年人，常表现为突然发生的心率加快伴呼吸困难、咳血性泡沫痰、肺部啰音等肺水肿症状。溶血性输血反应（P22）（A错）在病人输入十几毫升血型不合的血后即可出现严重反应。输血相关性过敏反应（P22）（B错）发生快，表现为皮肤局限性或全身性瘙痒或荨麻疹。输血相关败血症（D错）需要发病时间，且多表现为反复出现的畏寒、发热、皮疹等症状。输血相关的急性肺损伤（P23）（E错）常发生在输血后1～6小时内，也可出现急性呼吸困难、严重肺水肿等症状，但初期不影响循环功能，故心率一般不加快。